65岁女性，全口多数牙缺失，仅余留左上78，且松动Ⅲ°，牙龈红肿，牙槽嵴高度适中，颌间距离正常。修复前应做的工作是拔除左上78。拟采用的修复方法是
A. 全口义齿修复
B. 保留左上78，下颌为总义齿，上颌为可摘局部义齿
C. 保留左上7拔除左上8后，下颌为总义齿，上颌为可摘局部义齿
D. 保留左上7拔除左上8后，下颌为种植总义齿，上颌为可摘局部义齿
E. 以上方法均可

正确答案：A。全口义齿修复

解析：本题考查口腔修复方法。该患者全口多数牙缺失，仅余留左上78，且松动Ⅲ°，对于牙槽骨吸收达到根2/3以上，牙松动达Ⅲ度者予以拔除（BCD错）。但其牙槽嵴高度适中，颌间距离正常，因此可选择的修复方法是全口义齿修复（A对）。